单克隆抗体的优点说法正确的是
A. 纯度低
B. 效价低
C. 特异性强
D. 结构不均
E. 血清交叉反应

正确答案：C。特异性强

解析：单克隆抗体的优点：结构均一、纯度高、特异性强、效价高、少或无血清交叉反应、制备成本低。掌握“各类球蛋白的特性和功能”知识点。